治疗急性坏死型胰腺炎的较好药物是
A. 大量使用抗生素
B. 积极抗休克治疗
C. 生长抑素及其类似物
D. 用吗啡止痛
E. 补充液体和电解质

正确答案：C。生长抑素及其类似物

解析：治疗急性坏死型胰腺炎的较好药物是生长抑素及其类似物（C对），天然生长抑素由胃肠黏膜D细胞合成，可以抑制胰泌素和缩胆囊素刺激的胰液基础分泌。急性坏死型胰腺炎时，循环中生长抑素水平显著降低，可予以外源性补充生长抑素或生长抑素类似物来抑制胰液分泌，缓解症状。急性坏死型胰腺炎患者应选择针对革兰阴性菌和厌氧菌的、能透过血胰屏障的抗生素，而不是大量应用抗生素（A错）。由于吗啡可增加Oddi括约肌压力，故急性坏死型胰腺炎患者不宜使用吗啡（D错）。积极抗休克治疗（B错）、补充液体和电解质（C错）为急性胰腺炎的支持治疗。